具有解表清里功用的方剂是
A. 葛根黄芩黄连汤
B. 麻黄杏仁甘草石膏汤
C. 凉膈散
D. 小柴胡汤
E. 竹叶石膏汤

正确答案：A。葛根黄芩黄连汤

解析：该题考查葛根芩连汤的功用。葛根芩连汤方用葛根、甘草、黄芩、黄连，四药合用，外疏内清，表里同治，使表解里和，热利自愈。主治，邪热下利证，病因伤寒表证未解，邪陷阳明所致。功能解表清里（A对）。